60岁女性患者，2个半月前有车祸头受伤史，当时有一过性意识障碍，伤后头痛，逐渐好转，近半个月又出现头痛，越来越重，头颅CT示右额颞顶低密度新月状影像，脑室中线受压移位根本治疗是
A. 冬眠物理降温
B. 止血治疗
C. 预防感染
D. 钻孔冲洗引流术
E. 血肿清除术

正确答案：D。钻孔冲洗引流术

解析：老年女性患者，2个半月前头部外伤史，当时有一过性意识障碍，伤后头痛，好转后疼痛再次加重（颅内压增高的表现），头颅CT示右额颞顶低密度新月状影像（慢性硬膜下血肿的典型影像学表现）。结合患者病史、临床表现和影像学检查，应诊断为右额颞顶慢性硬膜下血肿。慢性硬膜下血肿的根本治疗方法为钻孔冲洗引流术（D对）：血肿较小者顶结节处钻一孔即可，较大者在额部再钻一孔，切开硬脑膜和血肿的壁层包膜，经骨孔置入导管于血腔内，用生理盐水反复冲洗直至流出液清亮为止。大多数患者经引流后可获得满意效果。冬眠物理降温（A错）、止血治疗（B错）、预防感染（C错）均为硬膜下血肿的辅助治疗措施，不能从根本上解决引起颅内压增高的原因。血肿清除术（E错）主要用于治疗病情较重的急性或亚急性硬膜下血肿。